矽肺X胸片上的大阴影指的是长径超过（）的阴影
A. 5mm
B. 10mm
C. 15mm
D. 20mm

正确答案：B。10mm

解析：本题考查大阴影的概念。大阴影指长径超过10mm（B对ACD错）的阴影，为晚期矽肺的重要X线表现。病理基础是团块状纤维化。大阴影周围一般有肺气肿带的X线表现。